胆酸显紫色，鹅去氧胆酸不显色的是
A. GregoryPascoe反应
B. Hammarsten反应
C. Gibb's反应
D. Emerson反应
E. Feigl反应

正确答案：B。Hammarsten反应

解析：本题考查的是胆汁酸类化合物的鉴别方法。胆酸显紫色，鹅去氧胆酸不显色的是Hammarsten反应（B对）。Hammarsten反应：用20%的铬酸溶液（将20g CrO₃置于少量水中，加乙酸至100ml）溶解少量样品，温热，胆酸显紫色，鹅去氧胆酸不显色。改良的Hammarsten反应是取少量样品用乙酸溶解，温热，加3～5滴浓盐酸，水浴加热至溶液浑浊并变黄色后，室温放置1～2小时，观察颜色变化，胆酸显紫色。去氧胆酸和鹅去氧胆酸无上述颜色变化。Gregory-Pascoe反应（A错）可用于胆酸的含量测定。Gregory-Pascoe反应：取1ml胆汁加6ml 45%硫酸及1ml 0.3%糠醛，密塞振摇后在65%水浴中放置30分钟，溶液显蓝色。该反应可用于胆酸的含量测定。Gibb's反应（C错）与Emerson反应（D错）为香豆素类的显色反应。Gibb's反应：Gibb's试剂是2，6-二氯（溴）苯醌氯亚胺，它在弱碱性条件下可与酚羟基对位的活泼氢缩合成蓝色化合物。Emerson反应：Emerson试剂是氨基安替比林和铁氰化钾，它可与酚羟基对位的活泼氢生成红色缩合物。Feigl反应（E错）为醌类化合物的显色反应。Feigl反应：醌类衍生物在碱性条件下加热与醛类、邻二硝基苯反应，生成紫色化合物。